男，45岁。畏寒、乏力、性欲减低1年。2年前曾因脑部肿瘤行放射治疗。多次因低血压、低血钠入院，静脉输注生理盐水治疗可好转。查体：T36℃，卧位BP120/70mmHg，心率90次/分，坐位BP100/60mmHg，心率110次/分。皮肤黏膜干燥，阴毛、腋毛稀疏，睾丸小。实验室检查：Hb103g/L，血细胞比容30%，血清尿素氮4mmol/L，血肌酐88.4μmol/L，血钠123mmol/L，血钾3.9mmol/L，血浆渗透压264mmol/L，尿渗透压354mmol/L。该患者最可能的诊断是
A. 原发性甲状腺功能减退症
B. 抗利尿激素分泌失调综合征
C. 腺垂体功能减退症
D. 体位性低血压
E. 原发性肾上腺皮质功能减退症

正确答案：C。腺垂体功能减退症

解析：患者曾因脑部肿瘤行放射治疗（此为腺垂体功能减退症的病因之一），出现性欲减低、阴毛、腋毛稀疏、睾丸小（性腺功能减退表现），畏寒、乏力（甲状腺功能减退），低钠、低血压（肾上腺功能减退表现），因此最可能的诊断为腺垂体功能减退症（C对）。原发性甲状腺功能减退症（A错）主要表现以代谢率减低和交感神经兴奋性下降为主，如畏寒、乏力；抗利尿激素分泌失调综合征（B错）和原发性肾上腺皮质功能减退症（E错）多数患者有低钠血症伴有血液渗透压降低，但它们无其他内分泌腺功能减退表现。体位性低血压（D错）表现为站位血压低于卧位血压，见于血容量不足或嗜铬细胞瘤等。